根据吸附原理对物质进行分离，属于化学吸附的是
A. 聚酰胺对黄酮类化合物的氢键吸附
B. 酸性硅胶对生物碱类化合物的吸附
C. 硅胶对黄酮类化合物的吸附
D. 氧化铝对生物碱类化合物的吸附
E. 活性炭对非极性物质的吸附

正确答案：D。氧化铝对生物碱类化合物的吸附

解析：本题考查的是吸附原理。根据吸附原理对物质进行分离属于化学吸附的是氧化铝对生物碱类化合物的吸附（D对）。在中药化学成分分离及精制工作中，吸附现象利用得十分广泛。其中又以固-液吸附用得最多，并有物理吸附、化学吸附及半化学吸附之分。物理吸附也叫表面吸附，是因构成溶液的分子（含溶质及溶剂）与吸附剂表面分子的分子间力的相互作用所引起。特点是无选择性，吸附与解吸附过程可逆，且可快速进行，故在实际工作中用得最广。常见如采用硅胶、氧化铝及活性炭（E错）为吸附剂进行的吸附色谱即属于这一类。硅胶吸附色谱法和氧化铝吸附色谱法可以用于柱色谱分离和薄层色谱分离。硅胶、氧化铝都为吸附剂，分离原理都是根据吸附能力大小不同进行分离。另外，氧化铝又分为酸性或碱性氧化铝，如黄酮等酚酸性物质被碱性氧化铝的吸附（C错），或生物碱被酸性氧化铝的吸附（B错）等，这又属于化学吸附。化学吸附，如黄酮等酚酸性物质被碱性氧化铝的吸附，或生物碱被酸性硅胶的吸附等，因为具有选择性，吸附十分牢固，有时甚至不可逆，故用得较少。聚酰胺吸附属于氢键吸附，力量较弱，介于物理吸附与化学吸附之间，也称半化学吸附。聚酰胺对黄酮类、醌类等化合物之间的氢键吸附效果较好，特别适合分离酚类、醌类、黄酮类化合物（A错）。